津液的生理功能是
A. 化生血液
B. 促进生长发育
C. 推动气血的运行
D. 维持体温的相对恒定
E. 温养脏腑、肌肉、皮毛

正确答案：A、E。化生血液；温养脏腑、肌肉、皮毛

解析：本题考查的是津液的生理功能。津液的生理功能是化生血液（A对）与温养脏腑、肌肉、皮毛（E对）。津液的生理功能：1.滋润和濡养作用：津的质地较清稀，布散于体表而滋润皮毛肌肤，输注于孔窍而滋润眼、鼻、口等；液的质地较浓稠，分布于脏腑脑髓而濡养脏腑，充养骨髓、脊髓、脑髓，流入骨节则关节滑利，屈伸自如。2.化生血液：津液不仅流行敷布于脉外，而且能进入脉内，化生血液，成为血液的组成部分。3.运输代谢废料：津液在代谢过程中，能把机体各部的代谢废料收集起来，通过脉内血液或脉外的途径，运输到有关排泄器官，不断地排出体外，以保证各组织器官的正常运行。例如，经皮肤汗孔排出的汗，经肾与膀胱排出的尿，其中除大最的水分外，就包含有许多代谢废物。促进生长发育（B错）为元气的生理功能。元气：又称“原气”，是人体最基本、最重要的气，是人体生命活动的原动力。元气的生理功能：推动和促进人体的生长发育，温煦和激发各脏腑、经络等组织器官的生理活动。元气是人体生命活动的原动力，是维持人体生命活动的最基本的物质。机体元气充沛，则各脏腑、经络等组织器官的活力旺盛，体质强健而少病。若因先天禀赋不足，或因后天水谷失养，或因久病损耗，以致元气的生成不足或耗伤太过时，就会形成元气虚衰而产生种种病变。推动气血的运行（C错）为宗气的生理功能。宗气：是积于胸中之气。宗气在胸中集聚之处，称作“气海”，又称“膻中”。宗气的生理功能：上走息道以行呼吸，贯注心脉以行气血。故凡语言、声音、呼吸的强弱，气血的运行，肢体的寒温和活动能力，视听功能，心搏的强弱及其节律等，皆与宗气盛衰有关。临床上亦常以心尖搏动部位（虚里）的搏动状况和脉象来了解宗气的盛衰。维持体温的相对恒定（D错）为卫气是生理功能。卫气：与营气相对而言，卫气行于脉外而属阳，又称“卫阳”。卫气的生理功能有三个方面：一是护卫肌表，防御外邪入侵；二是温养脏腑、肌肉、皮毛（E错）等；三是调节控制汗孔的开合和汗液的排泄，以维持体温的相对恒定。所以，人体卫外功能的强弱，以及能否维持体温的相对恒定，同卫气的功能活动是否正常有着密切关系。